有关正常月经，下述错误的是
A. 初潮是指第一次月经来潮
B. 经期是指每次月经持续的天数
C. 月经周期是指本次月经干净到下次月经来潮的天数
D. 经期一般为2～8天
E. 月经周期一般21～35天

正确答案：C。月经周期是指本次月经干净到下次月经来潮的天数

解析：正常月经具有周期性。出血第一日为月经周期开始，相邻两次月经第一日的间隔时间，称为一个月经周期。一般为21～35日，平均28日。月经持续时间称为经期，一般为2～8日，多为4～6日。掌握“女性生殖系统生理”知识点。